预防校正弱视最主要的措施是
A. 定期检查婴幼儿视力，早期发现，早期矫治
B. 注意用眼卫生，小儿看书距离不宜过近
C. 经常做眼保健操
D. 及早配戴眼镜
E. 以上都是

正确答案：A。定期检查婴幼儿视力，早期发现，早期矫治

解析：本题考查弱视预防保健措施。弱视预防保健措施：①注意用眼卫生：通过培养正确的看书、写字姿势、握笔方法，在良好的照明环境下读书、游戏，来培养儿童良好的用眼卫生习惯。②合理安排生活制度和保证营养：经常到户外活动，每天不少于2小时。注意合理营养和平衡膳食。③定期做视力筛查，做到早期发现，及时去除异常视觉环境，早矫正。④做眼保健操。其中最主要的是定期检查婴幼儿视力，早期发现，早期矫治（A对BCDE错）。